临床上行上牙槽后神经阻滞麻醉时，若进针过深，易刺破哪个部位而引起血肿
A. 面总静脉
B. 翼静脉丛
C. 面深静脉
D. 上颌静脉
E. 海绵窦

正确答案：B。翼静脉丛

解析：翼丛向后汇集成上颌静脉，在施行上牙槽后神经传导阻滞麻醉时，应正确掌握注射针的方向、角度及深度，避免刺破翼丛而发生血肿。掌握“口腔颌面颈部主要静脉的回流途径与范围”知识点。